酶的催化高效性是因为
A. 启动热力学不能发生的反应
B. 能降低反应的活化能
C. 能升高反应的活化能
D. 可改变反应的平衡点
E. 对作用物（底物）具有选择性

正确答案：B。能降低反应的活化能

解析：酶与一般催化剂一样，加速反应的作用都是通过降低反应的活化能（B对C错）实现的。酶只能催化热力学允许的化学反应（A错），只能加速反应进程而不改变反应的平衡点（D错），对其所催化的底物具有较严格的选择性，但其与酶的催化高效性无关（E错）。